重症残疾儿童日常清洁口腔辅助装置是
A. 冲牙器
B. 牙间隙刷
C. 电动牙刷
D. 改良牙刷
E. 牙线

正确答案：A。冲牙器

解析：使用电动牙刷和冲牙器等装置：使用电动牙刷可减轻残疾儿童刷牙时的疲劳，适用于手的灵活性受限，能够抓住牙刷柄并能把牙刷放入口内的残疾儿童。电动牙刷的刷柄也可以改装，以便适合于残疾儿童的需要。使用时应注意防止有可能会伤害口腔软组织。冲牙器利用水流的作用把滞留在口腔内的大块食物碎屑冲走，是重症残疾儿童日常清洁口腔的一种辅助装置。掌握“残疾人口腔保健”知识点。